根据《医疗用毒性药品管理办法》及相关规定，关于医疗用毒性药品生产、经营管理的说法，正确的是
A. 生产企业生产毒性药品每次配料必经二人以上复核无误，并详细记录每次生产所用原料和成品数
B. 医疗机构供应和调配毒性药品，必须凭执业医师签名的正式处方，且每次处方剂量不得超过三日极量
C. 药师调配处方时，对处方未注明用“生用”的毒性中药，可以付炮制品或生药材
D. 医疗用毒性药品专有标志的样式是黑白相间，白底黑字

正确答案：A。生产企业生产毒性药品每次配料必经二人以上复核无误，并详细记录每次生产所用原料和成品数

解析：本题考查医疗用毒性药品生产、经营要求。根据《医疗用毒性药品管理办法》及相关规定，关于医疗用毒性药品生产、经营管理的说法，正确的是生产企业生产毒性药品每次配料必经二人以上复核无误，并详细记录每次生产所用原料和成品数（A对）。医疗用毒性药品生产、经营要求：1.毒性药品年度生产、收购、供应和配制计划，由省（区、市）药品监督管理部门根据医疗需要制定并下达。2.毒性药品的生产企业须按审批的生产计划进行生产，不得擅自改变生产计划，自行销售。药品生产企业，必须由医药专业人员负责生产、配制和质量检验，并建立严格的管理制度。严防毒性药品与其他药品混杂。每次配料，必须经二人以上复核无误，并详细记录每次生产所用原料和成品数，经手人要签字备查。所有工具、容器要处理干净，以防污染其他药品。标示量要准确无误，包装容器要有毒药标志。3.生产毒性药品及其制剂，必须严格执行生产工艺操作规程，投料应在本企业药品检验人员的监督下准确投料，并建立完整的生产记录，保存五年备查。在生产毒性药品过程中产生的废弃物，必须妥善处理，不得污染环境。4.加工炮制毒性中药，必须按照国家药品标准进行炮制；国家药品标准没有规定的，必须按照省（区、市）药品监督管理部门制定的炮制规范进行炮制。药材符合药用要求的，方可供应、配方和用于中成药生产。5.零售药店供应和调配毒性药品，凭盖有医生所在的医疗单位公章的正式处方。每次处方剂量不得超过二日极量（B错）。医疗机构供应和调配毒性药品，须凭执业医师签名的正式处方。调配处方时，必须认真负责，计量准确，按医嘱注明要求，并由配方人员及具有药师以上技术职称的复核人员签名盖章后方可发出。对处方未注明“生用”的毒性中药，应当付炮制品（C错）。如发现处方有疑问时，须经原处方医生重新审定后再行调配。处方一次有效，取药后处方保存2年备查。毒性药品专有标志：根据《药品管理法》，特殊管理药品的包装和标签必须印有规定的标志。国务院药品监督管理部门规定的医疗用毒性药品的标志样式，颜色：黑白相间，黑底白字（D错）。